剧烈运动时
A. 调节性体温升高
B. 被动性体温升高
C. 两者均可
D. 两者均无
E. 无

正确答案：D。两者均无

解析：体温升高分为生理性体温升高（月经前期、剧烈运动、心理性应激等）和病理性体温升高（发热和过热）。剧烈运动引起的体温升高是生理性反应（D对），既不属于调节性体温升高（A错），也不属于被动性体温升高（B错）。